饮停部位在胸胁的是
A. 痰饮
B. 悬饮
C. 肺饮
D. 微饮
E. 留饮

正确答案：B。悬饮

解析：痰饮又可分为痰饮、悬饮、溢饮和支饮四种类型。悬饮是水饮流注于胁下，累及肝肺（B对）。痰饮是水饮聚于胃肠，与脾关系致密（A错）。肺饮是饮邪在肺，证见喘促短气，为支饮类证（C错）。支饮是水饮停留于胸膈，影响心肺。溢饮是水饮阻于四肢肌表，责之肺脾之脏（D错）。留饮是痰饮病的一种，因饮邪日久不化，留而不去，故名（E错）。